普通药品制剂
A. 生马钱子
B. 氢溴酸东莨菪碱
C. 川芎
D. 1%毛果芸香碱滴眼剂
E. 艾司唑仑

正确答案：D。1%毛果芸香碱滴眼剂